水体的浑浊度主要取决于
A. 悬浮于水中的砂土含量
B. 悬浮于水体中的胶体颗粒的含量
C. 悬浮于水体表面的细小颗粒物质的含量
D. 存在于水体中有机颗粒物的含量
E. 存在于水体中的无机物的含量

正确答案：B。悬浮于水体中的胶体颗粒的含量

解析：本题考查水体浑浊度的主要取决因素。水体的浑浊度主要取决于胶体颗粒的种类、大小、含量（B对ACDE错）、形状和折射指数。